舌
A. 可分为舌根、舌体、舌尖三部分
B. 在舌背，舌根、舌体以舌盲孔为界
C. 舌体、舌尖以界沟为界
D. 舌背的粘膜有许多舌乳头
E. 以上都不对

正确答案：D。舌背的粘膜有许多舌乳头

解析：舌可分为舌根和舌体两部分(A错)，舌根、舌体以V形界沟为界(B错)，舌尖为舌体上前部的结构(C错)，舌背的粘膜上有许多突起的舌乳头(D对)。